引起腹膜炎的细菌最多见的是
A. 大肠杆菌
B. 绿脓杆菌
C. 金黄色葡萄球菌
D. 产气杆菌
E. 变形杆菌

正确答案：A。大肠杆菌

解析：引起腹膜炎的细菌主要是胃肠道内的常住菌群，其中以大肠杆菌（A对）感染最为多见；其次为厌氧性杆菌、链球菌及变形杆菌等。